地方性氟中毒最主要是由于哪种因素引起的
A. 食物氟含量过高
B. 土壤中氟含量过高
C. 饮水氟含量过高
D. 饮水氟含量过低
E. 维生素A和钙缺乏

正确答案：C。饮水氟含量过高

解析：本题考查地方性氟中毒最主要的发病因素。地方性氟中毒是由于一定地区的环境中氟元素过多，而致生活在该环境中的居民经饮水、食物和空气等途径长期摄入过量氟所引起的以氟骨症和氟斑牙为主要特征的一种慢性全身性疾病。地方性氟中毒最主要是由于饮水氟含量过高（C对ABDE错）引起的，因为溶解于水溶液中的氟，包括饮水和饮料中的氟，几乎可以全部被消化道吸收。